对义齿无支持作用的口腔内松软组织，在修复前应
A. 给予切除
B. 不予处理
C. 行植骨术
D. 软组织加深术
E. 牙槽嵴重建术

正确答案：A。给予切除

解析：对松软组织的修整：有时由于戴用不良修复体过久，以致骨质大量吸收，表面被一种松软可移动的软组织所覆盖。对支持义齿没有帮助的松软组织，可以在修复前给予切除。掌握“修复前准备”知识点。